不宜用作甲亢常规治疗的药物是
A. 碘化物
B. 甲基硫氧嘧啶
C. 丙基硫氧嘧啶
D. 甲巯咪唑
E. 卡比马唑

正确答案：A。碘化物